呈卵圆形，具三棱，表面黄色，粗糙，有6条纵线的中药材是
A. 巴豆
B. 瓜蒌
C. 薏苡仁
D. 女贞子
E. 天仙子

正确答案：A。巴豆

解析：本题考查的是巴豆药材的性状鉴别。呈卵圆形，具三棱，表面黄色，粗糙，有6条纵线的中药材是巴豆（A对）。巴豆：【性状鉴别】药材呈卵圆形，一般具三棱。表面灰黄色或稍深，粗糙，有纵线6条，顶端平截，基部有果梗痕。破开果壳，可见3室，每室含种子1粒。种子呈略扁的椭圆形，表面棕色或灰棕色，一端有小点状的种脐及种阜的疤痕，另端有微凹的合点，其间有隆起的种脊；外种皮薄而脆，内种皮呈白色薄膜；种仁黄白色，油质。气微，味辛辣。瓜蒌（B错）：【性状鉴别】药材呈类球形或宽椭圆形。表面橙红色或橙黄色，皱缩或较光滑，顶端有圆形的花柱残基，基部略尖，具残存的果梗。轻重不一。质脆，易破开，内表面黄白色，有红黄色丝络，果瓤橙黄色，黏稠，与多数种子黏结成团。具焦糖气，味微酸、甜。薏苡仁（C错）：【性状鉴别】药材呈宽卵形或长椭圆形。表面乳白色，光滑，偶有残存的黄褐色种皮。一端钝圆，另端较宽而微凹，有1淡棕色点状种脐；背面圆凸，腹面有1条较宽而深的纵沟。质坚实，断面白色，粉性。气微，味微甜。女贞子（D错）：【性状鉴别】药材呈卵形、椭圆形或肾形。表面黑紫色或灰黑色，皱缩不平。基部有果梗痕或具宿萼及短梗。体轻。外果皮薄，中果皮较松软，易剥离，内果皮木质，黄棕色，具纵棱，破开后种子通常为1粒，肾形，紫黑色，油性。气微，味甘、微苦涩。天仙子（E错）药材的性状鉴别，2022年考试指南未明确说明。